《母婴保健法》规定的孕产期保健服务不包括
A. 母婴保健指导
B. 孕妇、产妇保健
C. 胎儿保健
D. 胎儿性别诊断
E. 新生儿保健

正确答案：D。胎儿性别诊断

解析：孕产期保健服务包括下列内容：①母婴保健指导（A对），对孕育健康后代，以及严重遗传性疾病和碘缺乏病等地方病的发病原因、治疗和预防方法提供医学意见；②孕妇、产妇保健（B对），为孕妇、产妇提供卫生、营养、心理等方面的咨询和指导以及产前定期检查等医疗保健服务；③胎儿保健（C对），为胎儿生长发育进行监护，提供咨询和医学指导；④新生儿保健（E对），为新生儿生长发育、哺乳和护理提供医疗保健服务。《母婴保健法》规定的孕产期保健服务不包括胎儿性别诊断（D错，为本题正确答案）。